血浆碳酸氢根离子浓度的平均值是
A. 21mmol/L
B. 24mmol/L
C. 22mmol/L
D. 25mmol/L
E. 27mmol/L

正确答案：B。24mmol/L

解析：血浆碳酸氢根离子浓度的平均值是24mmol/L（B对）。